腓浅神经支配
A. 腓骨长、短肌
B. 第3腓骨肌
C. 足底皮肤
D. 小腿后群肌
E. 小腿前群肌

正确答案：A。腓骨长、短肌

解析：腓浅神经支配腓骨长肌和腓骨短肌（A对），皮支分布于小腿外侧、足背（C错）和第2-5趾背的皮肤。小腿后群肌（D错）由胫神经支配。小腿前群肌（E错）由腓深神经支配。